病毒性心肌炎心肾阳虚证的用方是
A. 银翘散
B. 附子汤
C. 葛根芩连汤
D. 生脉散合复脉汤
E. 血府逐瘀汤合生脉散

正确答案：B。附子汤

解析：病毒性心肌炎心肾阳虚证是由于心肾阳虚，水饮凌心所致，治疗时应温阳利水，益气宁心，首选附子汤（B对）。银翘散（A错）其功用为辛凉透表，清热解毒，适用于病毒性心肌炎之风热犯心证。葛根芩连汤（C错）其功用为解表清里，适用于病毒性心肌炎之湿热侵心证。生脉散合复脉汤（D错），生脉散的功用为益气生津，敛阴止汗，复脉汤的功用为益气滋阴，通阳复脉，二者合用，适用于病毒性心肌炎之气阴亏虚证。血府逐瘀汤合生脉散（E错），血府逐瘀汤的功用为活血化瘀，行气止痛，生脉散的功用为益气生津，敛阴止汗，二者合用，适用于病毒性心肌炎之气虚血滞证。